使慢性粒细胞白血病达到血液学缓解首选的治疗是
A. 应用全反式维A酸
B. 应用干扰素–α
C. 放射治疗
D. 造血干细胞移植
E. 应用羟基脲

正确答案：E。应用羟基脲

解析：过去认为：能使慢性粒细胞白血病达到血液学缓解的首选药物是羟基脲（E）；能使慢性粒细胞白血病达到遗传学缓解的首选药物是α干扰素（B错）。现八版内科学认为分子靶向药物甲磺酸伊马替尼是慢性粒细胞白血病治疗的首选药物，可使患者血液学和遗传学获得较高的缓解率。全反式维A酸（P576）（A错）是急性早幼粒细胞白血病首选的治疗药物；放射治疗（C错）对白血病疗效差，仅用于中枢神经系统白血病的防治；造血干细胞移植（P579）（D错）是唯一可治愈慢粒的方法，主要适用于患者病情复发或难治的情况，不是首选治疗。按九版内科学观点，本题无正确答案，但给出的参考答案为E。